呼吸性酸中毒合并AG增高性代谢性酸中毒和代谢性碱中毒的特点是
A. PaCO₂明显增高
B. AG>16mmol/L
C. HCO₃⁻一般也升高
D. Cl⁻明显降低
E. 以上都是

正确答案：E。以上都是

解析：呼吸性酸中毒合并AG增高性代谢性酸中毒和代谢性碱中毒的特点是PaCO ₂明显增高（A对），AG>l6mmo/L（B对）, HCO ₃⁻般也升高（C对），Cl⁻明显降低（D对，故E为本题正确答案）。